成年男性患者，使用抗结核药物治疗肺结核数月，一周前出现头部持续性疼痛，3天前出现发热达38℃左右，今日头痛加重，出现昏迷，检查可见颈强，脑脊液轻度混浊，白细胞数为12×109/L，以淋巴细胞为多见，总蛋白1.5g/L（标准值为0.15～0.45g/L），集菌涂片镜检可见有芽生孢子和厚荚膜的菌体。除外结核性脑膜炎，最可能的诊断是
A. 白假丝酵母菌性脑膜炎
B. 新生隐球菌性脑膜炎
C. 流行性脑脊髓膜炎
D. 金黄色葡萄球菌性脑膜炎
E. 钩端螺旋体性脑膜炎

正确答案：B。新生隐球菌性脑膜炎

解析：题目中的临床体征表示患者出现脑膜炎的症状，新生隐球菌直接镜检内容为对于痰、脓液、离心沉淀后的脑脊液沉渣标本加墨汁染色镜检。见到圆形或卵圆形的有折光性的菌体，外周有一圈透明的肥厚荚膜即可确诊。掌握“真菌概述及主要病原性真菌”知识点。